安静时，下列哪一环境温度范围内能量代谢最稳定
A. 10～14℃
B. 15～19℃
C. 20～30℃
D. 31～35℃
E. 36～40℃

正确答案：C。20～30℃